材料四：某顾客持医院处方到药品零售企业购买处方药。药品零售企业工作人员对处方进行审核发现，处方所开药品已经售完，处方未注明用法用量，药品零售企业有同类药品，药品适应症与治疗目标相符，价格相对便宜。根据《处方管理办法》，关于该药品零售企业能否直接替换同类药品的说法，正确的是
A. 为顾客着想，可以在得到顾客同意的前提下调整处方内容并调配药品
B. 如该工作人员系执业药师，则可根据自己专业能力判断，属于可直接调配的情形
C. 在做好记录并开展处方点评的前提下可调配处
D. 相应情形非经医师修改和签字不得调配

正确答案：D。相应情形非经医师修改和签字不得调配

解析：本题考查的是药品零售企业销售处方药的要求。某顾客持医院处方到药品零售企业购买处方药。药品零售企业工作人员对处方进行审核发现，处方所开药品已经售完，处方未注明用法用量，药品零售企业有同类药品，药品适应症与治疗目标相符，价格相对便宜。根据《处方管理办法》，关于该药品零售企业能否直接替换同类药品的说法，正确的是相应情形非经医师修改和签字不得调配（D对）。药品零售企业销售处方药的要求：药品零售企业销售处方应当按照国家处方药与非处方药分类管理有关规定，凭处方销售处方药，处方保留不少于5年。处方应当经执业药师审核，调配处方应当经过核对，对处方所列药品不得擅自更改或代用。对有配伍禁忌或超剂量的处方，应当拒绝调配；必要时，经处方医师更正或确认重新签字后，方可调配销售。调配处方后，药学服务人员应当对照处方，核对药品名称、规格、剂型、数量、标签以及个人消费者姓名、性别、年龄等信息，正确无误后方可销售。根据《关于做好处方药与非处方药分类管理实施工作的通知》（国食药监安〔2005〕409号）的规定，对于部分滥用或超剂量使用会带来较大的安全性风险的药品，药品零售企业必须做到严格凭处方销售。此类药品包括所有注射剂、医疗用毒性药品、第二类精神药品、禁止零售的药品以外其他按兴奋剂管理的药品、精神障碍治疗药（抗精神病、抗焦虑、抗躁狂、抗抑郁药）、抗病毒药（逆转录酶抑制剂和蛋白酶抑制剂）、肿瘤治疗药、含麻醉药品的复方口服溶液和曲马多制剂、未列入非处方药目录的抗菌药物和激素，以及国家药品监督管理局公布的其他必须凭处方销售的药品。药品零售企业对疑似假冒或不合法处方，除拒绝调配外，还应当向所在地药品监督管理部门报告。